关于平喘药的叙述哪一项是错误的
A. 糖皮质激素具有抗炎平喘作用
B. 沙丁胺醇是β2受体激动剂
C. 异丙肾上腺素主要缺点是心率加快
D. 阿托品可用于哮喘发作
E. 色甘酸钠只能预防哮喘发作

正确答案：D。阿托品可用于哮喘发作

解析：阿托品只能抑制气管腺体分泌，但不能接触器管平滑肌痉挛，故不能作为平喘药物使用。掌握“平喘药”知识点。